外科感染的局部治疗方法中错误的是
A. 散瘀消肿
B. 患部适当活动，促进循环
C. 伴有严重中毒症状时切开减压
D. 必要时切除发炎脏器
E. 加强营养支持

正确答案：B。患部适当活动，促进循环

解析：外科感染时应局部制动与休息，避免活动，以防止炎症进一步扩散（B错，为本题正确选项）。散瘀消肿（A对）、加强营养支持（E对）为外科感染治疗的基础措施。当伴有严重中毒症状时切开减压（C对）可防止局部组织受压坏死，比如脓性指头炎患指剧烈疼痛、明显肿胀时及时切开引流可避免指骨坏死。必要时切除发炎脏器（D对）可避免炎症进一步扩散而危及生命，比如气性坏疽广泛感染整个肢体时应果断截肢。